平胃散与藿香正气散组成中均含有的药物是
A. 陈皮、白术
B. 陈皮、厚朴
C. 陈皮、苍术
D. 厚朴、苍术
E. 白术、厚朴

正确答案：B。陈皮、厚朴

解析：本题考查平胃散与藿香正气散的组成，属于记忆内容。平胃散功用燥湿运脾，行气和胃，由苍术、厚朴、陈橘皮、甘草组成藿香正气散解表化湿，理气和中，由大腹皮、白芷、紫苏、茯苓、半夏曲、白术、陈皮、厚朴、苦桔梗、藿香、甘草组成。陈皮、厚朴是两者中均含有的药物（B对）。趣记：平胃散,陈三厚苍术平胃。藿香正气散，二陈姐想找江苏白蜘蛛，补大腹皮。――二陈桔香枣姜苏白芷术，朴大腹皮。